温热性对人体的不良作用有
A. 伤阳
B. 助火
C. 伤阴
D. 耗气
E. 助寒

正确答案：B、C。助火；伤阴